猩红热患儿及疑似者，应隔离治疗
A. 3天
B. 4天
C. 5天
D. 6天
E. 至咽拭子培养阴性

正确答案：E。至咽拭子培养阴性

解析：猩红热预防：隔离传染源，猩红热患儿应隔离至咽拭子培养阴性时。密切接触的带菌者，也应隔离，并同时用青霉素治疗；切断传播途径，流行期间，禁止小儿去公共场所，接触病人要戴口罩，对病人的污染物、分泌物及时消毒处理（E对）。